实喘病位主要在
A. 肝
B. 心
C. 脾
D. 肺
E. 肾

正确答案：D。肺

解析：喘证的病变部位主要在肺和肾，与肝脾心相关。实喘者，多由外邪、痰浊、肝郁气逆致肺宣降不利而发，故病位在肺（D对）。虚喘者，病位在肺、肾，虚喘可肺病及脾，子盗母气，致脾气亦虚，脾虚失运，聚湿生痰，喘证后期肾阳衰微，水无所主，水邪泛滥，可上凌心肺，影响心（ABCE错）。